多数成年人发生的龋损呈现组织染色深，病变组织干燥，称为
A. 线性釉质龋
B. 平滑面龋
C. 静止性龋
D. 浅龋
E. 慢性龋

正确答案：E。慢性龋

解析：慢性龋进展慢，龋坏组织染色深，呈黑褐色，病变组织较干脆，又称干性龋，多数成年人发生的龋菌属此类。掌握“龋病的临床表现与分类”知识点。